血府逐瘀汤除活血祛瘀外，还具有的功用是
A. 散结消痞
B. 温经散寒
C. 补气通络
D. 行气止痛
E. 疏肝解郁

正确答案：D。行气止痛

解析：血府逐瘀汤方证主治诸症皆为淤血内阻胸隔，气机瘀滞所致。治则活血化瘀，行气止痛（D对）。